通过腕管的结构有
A. 桡侧腕屈肌肌腱
B. 尺侧腕屈肌肌腱
C. 掌长肌肌腱
D. 拇长展肌肌腱
E. 指浅屈肌肌腱

正确答案：E。指浅屈肌肌腱

解析：通过腕管的结构有指浅屈肌肌腱（E对）、指深屈肌肌腱及拇长屈肌肌腱。